循行于内踝尖上八寸以下胫骨内侧前缘的经脉是
A. 足少阳胆经
B. 足少阴肾经
C. 足厥阴肝经
D. 足太阴脾经
E. 足阳明胃经

正确答案：C。足厥阴肝经

解析：本题考查足三阴经在下肢的分布规律。足三阴经在足内踝上8寸以下为厥阴在前（C对）、太阴在中（D错）、少阴在后（B错）。足三阳经在下肢外侧循行为阳明在前（E错）少阳在中（A错）太阳在后。